长期服用可致磷酸激酶升高的药物
A. 伊曲康唑
B. 阿昔洛韦
C. 氯丙嗪
D. 异烟肼
E. 辛伐他汀

正确答案：E。辛伐他汀

解析：本题考查药物的不良反应。长期服用可致磷酸激酶升高的药物是辛伐他汀（E对）。肌酸激酶（CK）是人体能量代谢过程中的重要酶类，旧称肌酸磷酸激酶（CPK），服用羟甲戊二酰辅酶A还原酶抑制剂（他汀类药物），或和贝特类药联合应用可增加发生肌病的危险，表现为CK升高。伊曲康唑（A错）的不良反应有肝脏转氨酶AST和ALT升高。阿昔洛韦（B错）为广谱抗病毒药，该类药物常见肾损害、急性肾小管坏死、急性肾衰、尿毒症、泌尿道刺激症状等不良反应。氯丙嗪（C错）的主要不良反应为锥体外系反应。异烟肼（D错）的不良反应有肝脏毒性，轻度一过性肝损害，黄疸及周围神经炎。